影响血管紧张素Ⅱ形成的药物是
A. 硝苯地平
B. 卡托普利
C. 哌唑嗪
D. 可乐定
E. 利血平

正确答案：B。卡托普利

解析：本题考查影响血管紧张素Ⅱ形成的药物。卡托普利（B对）为血管紧张素转化酶抑制剂，能够抑制血管紧张素Ⅰ转换成血管紧张素Ⅱ，血管紧张素Ⅱ生成减少，并能抑制醛固酮分泌，减少水钠潴留，产生降压作用。硝苯地平（A错）为钙离子通道阻滞剂，临床适用于预防和治疗冠心病心绞痛。哌唑嗪（C错）为α₁受体阻滞药，能够扩张血管。可乐定（D错）为中枢性α₂受体激动剂。利血平（E错）是肾上腺素能神经元阻断性抗高血压药。